食品中所含热能和营养素能满足人体需要的程度被称为
A. 食品的营养素密度
B. 食品的营养价值
C. 食品的热能密度
D. 食品的营养质量指数
E. 以上都不是

正确答案：B。食品的营养价值